卫生行政部门
A. 主管全国饮用水卫生管理工作
B. 主管全国饮用水卫生监督工作
C. 必须取得县级以上地方人民政府卫生行政部门签发的卫生许可证
D. 除必须取得卫生许可证外，还必须取得《城市供水企业资质证书》
E. 必须取得体检合格证后方可上岗工作

正确答案：B。主管全国饮用水卫生监督工作